作为固定桥的基牙，必须是
A. 活髓牙
B. 牙体组织健康，完整无缺
C. 牙周组织健康
D. 基牙排列正常无倾斜
E. 基牙不能咬合过紧

正确答案：C。牙周组织健康

解析：本题考查固定桥基牙的选择。基牙要承担自身的和桥体的（牙合）力，牙周组织健康（C对）是基牙选择的最关键因素和必要条件。活髓（A错）是基牙最理想的状态，但是若牙髓有病变，经完善治疗和长时间观察后，证实不影响固位者，也可用作基牙。存在牙体组织缺损的牙（B错），治疗后不影响固位者，可以用作基牙。基牙排列正常无倾斜（D错）是最好的，但是有一定的倾斜角度，通过调整就位道也可以作为基牙，所以这不是必须的。基牙不存在咬合过紧（E错）是最好的，但是存在咬合过紧时，通过调节也可以作为基牙，所以这不是必须的。